为使所取样品具有代表性，当产品总件数为100时，则取样件数为
A. 100
B. 50
C. 11
D. 10
E. 9

正确答案：C。11

解析：本题考查抽样调查。抽样调查中，若产品总件数为x，则取样件数为√x+1，故当产品件数为100时，取样件数为√100+1=11。